女，42岁，参加宴会后突发中上腹持续性疼痛伴恶心、呕吐8小时来诊，既往无胃病史。查体：T38℃，巩膜无黄染，上腹偏左有压痛及轻度肌紧张，肝浊音界正常，Murphy征阴性，肠鸣音正常。最可能的诊断是
A. 急性肠梗阻
B. 急性阑尾炎
C. 急性胆囊炎
D. 急性胰腺炎
E. 消化性溃疡穿孔

正确答案：D。急性胰腺炎

解析：急性胰腺炎常在饱餐和饮酒后突然发作，表现为急性腹痛，常较剧烈，且腹痛多位于左上腹，部分患者可有恶性、呕吐、轻度发热的症状。患者中年女性，参加宴会后突发中上腹持续性疼痛伴恶心、呕吐，发热，上腹偏左有压痛及轻度肌紧张，巩膜无黄染，Murphy征阴性，患者临床表现与急性胰腺炎相符，故患者最可能的诊断为急性胰腺炎（D对）。急性肠梗阻早期有腹痛、呕吐、腹胀、排气排便停止，且肠鸣音亢进（A错）。急性阑尾炎表现为转移性右下腹痛、发热、恶心、呕吐，体检右下腹固定压痛、反跳痛、肌紧张、肠鸣音减弱或消失（B错）。急性胆囊炎主要表现为上腹部疼痛，常在夜间发作，放射到右肩、肩胛和背部，伴恶心、呕吐、厌食等消化道症状，10%～20%可出现黄疸，Murphy征阳性（C错）。消化性溃疡穿孔表现突发上腹部剧痛，呈“刀割样”，伴有恶心、呕吐，严重者可有血压下降，腹式呼吸减弱或消失，全腹压痛、反跳痛明显，可出现典型的“板状腹”体征，X线检查可见膈下新月状游离气体影（E错）。